患者，女，22岁。寒战高热，腰痛，尿频，尿急，灼热刺痛，舌红苔黄，脉濡数。检查：体温38℃，双肾区叩击痛，血白细胞19.5×10⁹/L，中性粒细胞0.90×10⁹/L，尿白细胞20个/高倍视野，尿大肠杆菌培养，菌落记数＞105/L。治疗应首选
A. 庆大霉素加八正散
B. 氟哌酸加益元散
C. 氟哌酸加龙胆泻肝汤
D. 庆大霉素加萆薢分清饮
E. 庆大霉素加知柏地黄汤

正确答案：A。庆大霉素加八正散

解析：湿热蕴结下焦，膀胱气化失司，故见寒战高热，尿频，尿急，灼热刺痛；腰为肾之府，若湿热之邪侵犯肾，则腰痛拒按；舌红苔黄，脉濡数均系湿热之象。双肾区叩击痛，血白细胞升高，尿大肠杆菌培养升高，故可诊断为肾盂肾炎膀胱湿热证，西医治疗应选用致病菌敏感的抗生素，无病原学结果前，一般首选对格兰阴性杆菌有效的抗生素，尤其是首发尿路感染。治疗3天症状无改善，应按药敏结果调整用药，所选抗生素在尿和肾内的浓度要高，选择肾毒性小，副作用少的抗生素，故可选用庆大霉素抗感染。膀胱湿热证治法为清热利湿通淋，代表方为八正散加减（A对）。益元散（B错）可以清暑利湿，治疗感受暑湿，身热心烦，口渴喜饮，小便短赤。龙胆泻肝汤（C错）可清利肝经湿热，治疗肝经湿热下注证。萆薢分清饮（D错）可以温暖下元，分清化浊，治疗下焦虚寒之膏琳、白浊。知柏地黄丸（E错）可滋阴益肾，清热通淋，治疗肾阴不足，湿热留恋证。